印堂穴的进针法应采用
A. 舒张进针
B. 提捏进针
C. 夹持进针
D. 指切进针
E. 单手进针

正确答案：B。提捏进针

解析：印堂处皮肉比较浅薄，应用提捏进针法（B对）。舒张进针法用于皮肤松弛部位的腧穴（A错）。夹持进针法适用于长针的进针（C错）。指切进针法主要用于短针的进针（D错）。单手进针法多用于较短的毫针（E错）。